为利于粉碎、杀酶保苷，芥子宜选用的炮制方法是
A. 扣锅煅炭
B. 米炒
C. 麸炒
D. 炒黄
E. 炒炭

正确答案：D。炒黄

解析：本题考查的是芥子的炮制方法。为利于粉碎、杀酶保苷，芥子宜选用的炮制方法是炒黄（D对）。芥子：【炮制方法】处方用名有芥子、白芥子、炒芥子、炒白芥子。①芥子：取原材料，去净杂质，用时捣碎。②炒芥子：取净芥子，置炒制容器内，用文火加热，炒至淡黄色至深黄色（炒白芥子）或深黄色至棕褐色（炒黄芥子），有爆鸣声，断面浅黄色，有香辣气时即可。用时捣碎。芥子主要含有硫苷化合物，本身无刺激性，酶解后生成异硫氰酸酯类（芥子油）具有辛辣味和刺激性，炒后可杀酶保苷，使其服用后在胃肠道环境中缓慢分解，逐渐释放出芥子油而发挥治疗作用。扣锅煅（A错），又称密闭煅、闷煅、暗煅。煅炭的主要目的：①改变药物性能，产生或增强止血作用，如血余炭等。②降低毒性，如干漆等。采用扣锅煅法炮制的中药有血余炭等。米炒（B错）的目的：①增强药物的健脾止泻作用，如党参。②降低药物的毒性，如红娘子、斑蝥。③矫正不良气味，如昆虫类药物。麸炒（C错）的目的：①增强疗效，如山药、白术、芡实等。②缓和药性，如苍术、枳实、薏苡仁等。③矫臭矫味，如僵蚕等。炒炭（E错）的目的：经炒炭炮制后可使药物增强或产生止血、止泻作用。